表面活性剂具有溶血作用，下列表面活性剂溶血作用从大到小的正确排列顺序是
A. 聚氧乙烯脂肪酸脂＞聚氧乙烯芳基醚＞吐温80＞吐温20
B. 聚氧乙烯芳基醚＞聚氧乙烯脂肪酸脂＞吐温20＞吐温80
C. 吐温80＞吐温20＞聚氧乙烯脂肪酸脂＞聚氧乙烯芳基醚
D. 吐温20＞吐温80＞聚氧乙烯芳基醚＞聚氧乙烯脂肪酸脂
E. 聚氧乙烯脂肪酸脂＞吐温20＞吐温40＞聚氧乙烯芳基醚

正确答案：B。聚氧乙烯芳基醚＞聚氧乙烯脂肪酸脂＞吐温20＞吐温80

解析：本题考查表面活性剂。表面活性剂溶血作用的顺序为：聚氧乙烯烷基醚＞聚氧乙烯芳基醚＞聚氧乙烯脂肪酸酯＞吐温20＞吐温60＞吐温40＞吐温80（B对）。